以下关于精神障碍管理的说法错误的是
A. 精神障碍的住院治疗实性自愿原则
B. 精神障碍患者的监护人无权拒绝医疗机构对患者实施住院治疗
C. 精神障碍的诊断应当由精神科职业医师作出
D. 精神障碍的诊断应当以精神健康状况为依据
E. 医疗机构接到送诊的疑似精神障碍患者，不得拒绝为其作出诊断

正确答案：B。精神障碍患者的监护人无权拒绝医疗机构对患者实施住院治疗

解析：本题考查精神障碍管理。关于精神障碍管理的说法错误的是精神障碍患者的监护人无权拒绝医疗机构对患者实施住院治疗（B错，为本题的正确答案）。精神障碍的住院治疗实性自愿原则（A对）；精神障碍患者已经发生伤害自身的行为，或者有伤害自身的危险情形的，经其监护人同意，医疗机构应当对患者实施住院治疗；监护人不同意的，医疗机构不得对患者实施住院治疗；精神障碍的诊断应当由精神科职业医师作出（C对）；精神障碍的诊断应当以精神健康状况为依据（D对）；医疗机构接到送诊的疑似精神障碍患者，不得拒绝为其作出诊断（E对）。